初产妇，孕40周临产，规则宫缩12小时，破膜10小时，肛查：宫口开大5cm，先露+0.5。首先应考虑的诊断是
A. 胎膜早破
B. 正常潜伏期
C. 正常活跃期
D. 潜伏期延长
E. 第一产程延长

正确答案：C。正常活跃期

解析：本题患者宫口开至5cm（现在为6cm）为活跃期的标志（C对）。胎膜早破是在没有什么特殊的情况下，突然阴道多量的持续的流水，这样就怀疑是胎膜早破（A错）。潜伏期是指从规律宫缩至宫口扩张6cm的时期（B错）。初产妇>20 小时、经产妇>14小时称潜伏期延长，本题患者12小时（D错）。初产妇第一产程所需时间大约在11—12个小时（E错）。